欲调查某地HbsAg携带情况，可采用
A. 前瞻性调查
B. 抽样调查
C. 爆发调查
D. 回顾性调查

正确答案：B。抽样调查

解析：本题考查抽样调查的用途。抽样调查（B对ACD错）是通过对样本中的研究对象的调查研究来推论其所在总体的情况的一种研究方法。通过调查某地HBsAg的携带情况，采取普查耗费巨大，可采用抽样调查的方法用样本来估计总体的情况。